下列哪一项不是心肌梗死的并发症
A. 心脏破裂
B. 梗死后综合征
C. 肺动脉栓塞
D. 心室壁瘤
E. 主动脉窦瘤破裂

正确答案：E。主动脉窦瘤破裂

解析：本题考查冠状动脉粥样硬化性心脏病。主动脉窦瘤破裂（E错，为本题正确答案）不是心肌梗死的并发症。心肌梗死并发症：乳头肌功能失调或断裂、心脏破裂（A对）、动脉栓塞（C对）、心室壁瘤（D对）、心肌梗死后综合征（B对）。